具有促进油脂氧化作用的营养素是
A. 维生素B₁
B. 铁
C. 碘
D. 维生素E
E. 维生素C

正确答案：B。铁